男性，25岁，口腔内上下前牙龈乳头消失并凹陷，呈反波浪形，牙龈间乳头颊舌侧分离，可从牙面翻开，下方有牙石、牙垢，无龈坏死。可能的原因是
A. 疱疹性龈口炎
B. 中性粒细胞缺乏引起龈坏死
C. 慢性龈缘炎
D. 慢性坏死性龈炎
E. 龈乳头炎

正确答案：D。慢性坏死性龈炎

解析：本题考查慢性坏死性龈炎的临床表现。此病例的表现是慢性坏死性龈炎（D对）的典型表现：龈乳头消失、凹陷，反波浪形，龈乳头颊舌侧分离，可从牙面翻开，而无龈坏死。疱疹性龈口炎（A错）出现粟粒状大小的水疱不会出现龈乳头消失并凹陷，呈反波浪形。中性粒细胞缺乏引起龈坏死（B错）牙龈溃疡糜烂经久不愈，病理检查出现中性粒细胞减少。慢性龈缘炎（C错）不会出现龈乳头消失及反波浪形龈外形，出现龈缘和龈乳头肿胀肥厚。龈乳头炎（E错）也不会出现龈乳头消失及反波浪形龈外形，出现龈乳头发红肿胀。